磺胺甲噁唑片含量测定使用的滴定液是
A. 硫酸铈滴定液
B. 硝酸银滴定液
C. 氢氧化钠滴定液
D. 亚硝酸钠滴定液
E. 碘滴定液

正确答案：D。亚硝酸钠滴定液